多数补体成分灭活的标准温度和时间是
A. 0℃，24小时
B. 4℃，2小时
C. 37℃，30分钟
D. 56℃，30分钟
E. 100℃，15分钟

正确答案：D。56℃，30分钟